口腔黏膜消毒应首选
A. 甲醛
B. 石碳酸
C. 0.1%新洁尔灭
D. 0.5%亚硝酸钠
E. 2.5%碘伏

正确答案：C。0.1%新洁尔灭

解析：新洁尔灭是一种季铵盐阳离子表面活性剂，别名为苯扎溴铵溴化苄烷铵，广泛应用于制药及医疗行业的表面及皮肤消毒.其水溶液振摇时产生多量泡沫，带有芳香气味，但尝味极苦，具有耐热性，杀菌力强，对革兰氏阳性杆菌及球菌、真菌均有效，对藻类、真菌、异养菌等均有较好的杀生效果；对革兰氏阴性杆菌及肠道病毒作用弱，对结核杆菌及芽孢无效；对皮肤和组织无刺激性，对金属、橡胶制品无腐蚀作用，可贮存较长时间而效果不减，新洁尔灭杀菌作用快，不污染衣服、性质稳定、易于保存、属消毒防腐类药。稀释液可用于制药设备及洁净区的消毒，外科手术前洗手，皮肤消毒和霉菌感染，黏膜消毒，器械消毒，忌与肥皂，盐类或其他合成洗涤剂同时使用。溶液广泛用于手、皮肤、黏膜（C对）、器械等的消毒，其杀菌效力为苯酚的倍，具有良好的分散作用和粘膜剥离作用。